男，35岁。因发热5天，尿少1天于1月10日就诊。查体：T37.8℃，P108次／分，BP80/55mmHg，面部潮红，球结膜充血水肿，腋下可见出血点。实验室检查：血WBC19×10⁹/L，异型淋巴细胞15%，尿蛋白（+++）。首先考虑的诊断是
A. 急性肾盂肾炎
B. 肾综合征出血热
C. 伤寒
D. 钩端螺旋体病
E. 流感

正确答案：B。肾综合征出血热

解析：患者中青年男性（肾综合征出血热的易感人群），发热、尿少、BP80/55mmHg（提示休克）、球结膜充血水肿、腋下可见出血点（符合肾综合征出血热的临床表现），血WBC19×10⁹/L（正常范围4～10×10⁹/L），异型淋巴细胞15%（正常范围是0～2%，明显升高提示病毒感染可能性大），大量蛋白尿提示肾病综合征，根据患者的临床表现及实验室检查最可能的的诊断是肾综合征出血热（B对）。急性肾盂肾炎（A错）多见于育龄女性，临床表现可有发热、寒战、头痛、全身酸痛等全身症状，尿频、尿急、尿痛、排尿困难等泌尿系统症状及腰痛。伤寒（C错）发热期长，多无低血压，少见出血及尿量变化，症状以面色苍白、表情淡漠、相对缓脉为主，白细胞正常或减少，尤以嗜酸性粒细胞减少为著。钩端螺旋体病（D错）患者有疫水接触史，高热、乏力显著，同时伴胖肠肌压痛和全身淋巴结肿大，异型淋巴细胞少见。流感（E错）临床特点为上呼吸道卡他症状较轻，而高热、头痛、乏力等全身中毒症状较重，白细胞总数正常或降低，淋巴细胞相对升高。